在高血压的发病机制中，属于细胞膜离子转运异常的是
A. 水钠潴留和血容量增加
B. 交感神经活性增加
C. 血管张力增加
D. 血管紧张素增加
E. Ca²⁺通透性增加

正确答案：E。Ca²⁺通透性增加